细胞化学染色变化为髓过氧化物酶（＋＋＋）、糖原染色（—）的疾病是
A. 急性巨核细胞白血病
B. 急性单核细胞白血病
C. 急性早幼粒细胞性白血病
D. 急性粒细胞白血病未分化型
E. 急性淋巴白血病

正确答案：C。急性早幼粒细胞性白血病

解析：细胞化学主要用于协助形态鉴别各类白血病。细胞化学染色变化为髓过氧化物酶（＋＋＋）、糖原染色（—）的白血病类型是急性早幼粒细胞性白血病（C对）。细胞化学染色变现为髓过氧化物酶（—）、糖原染色（＋）的白血病类型是急性淋巴白血病（E错）。细胞化学染色变化为非特异性酯酶（＋），可被氟化钠抑制≧50%的白血病类型是急性单核细胞白血病（B错）。